大于多少岁生育者，应在孕中期做胎儿细胞染色体检查以排除染色体异常儿
A. 大于30岁
B. 大于35岁
C. 大于40岁
D. 大于45岁
E. 大于38岁

正确答案：B。大于35岁

解析：本题考查产前筛查与诊断。35岁及以上者（B对ACDE错）为高龄孕妇，子代患病风险高，应做产前诊断，排除染色体异常儿。